广义的颊间隙是指
A. 咬肌与颊肌之间存在的一个狭小的筋膜间隙，颊脂垫正位于其中
B. 位于下颌下三角内，间隙中包含有下颌下腺、下颌下淋巴结，并有面动脉、面静脉、舌神经、舌下神经通过
C. 位于颊部皮肤与颊黏膜之间、颊肌周围的间隙
D. 位于颅中窝底，下界是翼外肌下缘平面，并与翼下颌间隙分界。
E. 位于下颌支内侧骨壁与翼内肌外侧面之间

正确答案：C。位于颊部皮肤与颊黏膜之间、颊肌周围的间隙

解析：颊间隙有广义和狭义之分。广义的颊间隙系指位于颊部皮肤与颊黏膜之间、颊肌周围的间隙。掌握“下颌下间隙、颊间隙感染”知识点。